奇经八脉与十二经脉之气相交会的八个腧穴称为
A. 原穴
B. 郄穴
C. 八会穴
D. 下合穴
E. 八脉交会穴

正确答案：E。八脉交会穴

解析：八脉交会穴为奇经八脉与十二经脉之气相通的腧穴（E对）；原穴（A错）为脏腑原气输注、经过和留止于十二经脉四肢部的腧穴；郄穴（B错）为十二经脉和奇经八脉中的阴维、阳维、阴跷、阳跷脉之经气深聚的部位；八会穴（C错）为脏、腑、筋、脉、气、血、骨、髓等精气会聚的8个腧穴；下合穴（D错）为六腑之气下合于下肢足三阳经的腧穴。